发生突发公共卫生事件时，健康教育者的首要任务是
A. 开展相关人员培训
B. 组织相关专家座谈
C. 开展调查研究
D. 设计干预方案
E. 迅速有效的信息传播

正确答案：E。迅速有效的信息传播